属于Ⅱ型超敏反应的是
A. 系统性红斑狼疮
B. 溶血性贫血
C. 过敏性鼻炎
D. 血清病
E. 荨麻疹

正确答案：B。溶血性贫血

解析：Ⅱ型超敏反应又称为细胞型或细胞毒型超敏反应，是由IgG或IgM抗体与靶细胞表面相应抗原结合后，在补体、吞噬细胞和NK细胞参与下，引起的以细胞溶解或组织损伤为主的病理免疫反应。与Ⅱ型超敏反应有关的疾病有输血反应、新生儿溶血病、溶血性贫血（B对）、药物过敏性血细胞减少症等。过敏性鼻炎（C错）、荨麻疹（E错）属于I型超敏反应。系统性红斑狼疮（错）、血清病（D错）是Ⅲ型超敏反应。